水性涂料环境标志产品的基本要求中，挥发性有机物（VOC）含量应小于
A. 250g/L
B. 260g/L
C. 270g/L
D. 280g/L
E. 300g/L

正确答案：A。250g/L

解析：本题考查水性涂料环境标志产品的基本要求中，挥发性有机物（VOC）的含量。水性涂料环境标志产品的基本要求中，挥发性有机物（VOC）含量应小于250g/L（A对BCDE错）。